粘接力的产生是由
A. 分子间结合键的键力
B. 吸附力
C. 分子引力
D. 机械嵌合力
E. 由以上各种力共同产生

正确答案：E。由以上各种力共同产生

解析：本题考查粘接力形成的机制。粘接力的产生与分子间结合键的键力（A对）有关，有些粘接物和被粘物之间有化学键形成。固体表面的原子或分子因范德瓦尔斯力的作用能够吸附外界的液体和气体，既是分子引力（C对）的体现，又是吸附力（B对）产生的原因之一。此外，由于物体的表面经放大后看是十分粗糙、遍布沟壑的、多孔性的，所以物体间容易产生微机械嵌合力（D对），这种力也是普遍存在的。（ABCD均对，故E为本题的正确答案）。